与铸造卡环相比，锻丝卡环的特点是
A. 不容易调改
B. 与基牙牙面密合
C. 弹性好，固位力较强
D. 交互对抗作用好
E. 支持作用好

正确答案：C。弹性好，固位力较强

解析：本题考查锻丝卡环的特点。锻丝卡环是用圆形不锈钢丝弯制而成，其弹性好，固位力较强（C对）。而铸造卡环一般是用合金、纯钛等通过制作熔模、包埋、失蜡铸造而成，不容易调改（A错），与基牙牙面密合（B错），固位、支持（E错）、卡抱作用及交互对抗作用（D错）较好。